下列描述中属于漏出液特点的是
A. 细胞数常小于100×106/L
B. Rivalta试验阳性
C. 外观多混浊
D. 蛋白定量在25g/L以下
E. 比重多在1.018以上

正确答案：A。细胞数常小于100×106/L

解析：漏出液外观透明清亮（C错），静置不凝固，比重＜1.016~1.018（E错），细胞数常少于100×106/L（A对），以淋巴细胞和间皮细胞为主。漏出液蛋白含量较低（＜30g/L）（D错），以白蛋白为主，黏蛋白试验（Rivalta试验）阴性（B错）。